在AIDS高发省，发现AIDS感染者最好采取哪种方法
A. 普查
B. 分层抽样调查
C. 整群抽样调查
D. 系统抽样调查
E. 对高危人群调查

正确答案：E。对高危人群调查